男，50岁。大便变细、次数增多3个月，伴肛门下坠感、里急后重，常有黏液血便，进行性加重。首先应进行的检查是
A. 腹部B超
B. 直肠镜
C. 下消化道X线钡剂造影
D. 直肠指诊
E. 大便隐血

正确答案：D。直肠指诊

解析：患者老年男性，大便变形伴次数增多，肛门下坠、里急后重（直肠刺激症状），有血便，应考虑直肠癌。直肠指诊（D对）操作简单、效果显著，应作为首先检查。肠道为空腔器官，含气较多，影响腹部B超（A错）成像。直肠镜（B错）可以直接观察病变部位，宜作为直肠指诊阳性的后续检查。下消化道X线钡剂造影（C错）是结肠癌的重要检查方法，对于直肠癌意义不大。大便隐血（E错）仅适用于大规模普查或高危人群的初筛。